针对艾滋病高危人群举办“艾滋病传播途径”的专题讲座，根据健康信念模式，其目的是使他们知觉到
A. 疾病的易感性
B. 疾病的危害性
C. 预防保护行为的益处
D. 预防保护行为的障碍
E. 自我效能

正确答案：A。疾病的易感性